促进机体生长发育的物质是
A. 正气
B. 邪气
C. 谷气
D. 元气
E. 四气

正确答案：D。元气

解析：本题考查的是元气的生理功能。促进机体生长发育的物质是元气（D对）。元气的生理功能：推动和促进人体的生长发育，温煦和激发各脏腑、经络等组织器官的生理活动。正气（A错），是指存在于人体、具有抗邪愈病作用的各种物质与功能的总称。邪气（B错），是指存在于外在环境中，或人体内部产生的具有致病作用的各种因素的总称。谷气（C错），即水谷精气，来源于饮食物，通过脾胃运化功能而生成。四气（E错），指中药的寒、热、温、凉四种性质和作用。